下列关于胸膜间皮瘤所致胸腔积液叙述正确的是
A. 是漏出液
B. 是渗出液
C. 介于漏出液和渗出液之间
D. LDH＜200U
E. 比重＜1.018

正确答案：B。是渗出液

解析：渗出液为炎性积液，由于病原微生物毒素、缺氧、炎症介质、肿瘤等导致血管内皮受损，导致血管通透性增加，大分子物质渗出血管壁。胸膜间皮瘤时，胸膜有类似渗出的反应，所致胸腔积液为渗出液（B对）。漏出液（A错）为非炎性液，其形成的主要原因是血浆胶渗压降低、毛细血管流体静压升高、淋巴管阻塞等。LDH（乳酸脱氢酶）、液比重为鉴定渗出液与漏出液的重要指标，＜200IU提示为漏出液（D错），＞200IU提示为渗出液；积液比重＜1.018提示漏出液（E错），比重＞1.018提示渗出液。